李某，11岁，因发热浮肿、血尿入院，自幼时常咽喉痛，发烧，曾因心脏杂音卧床一个月。入院前3周又因咽痛发热而注射青霉素数日，症状消失，但入院前三日又突发高热，血尿，眼睑浮肿。入院查体体温39℃，血压稍高，心脏有二级以上收缩期杂音。化验结果：尿红细胞满视野，颗粒管型3～5个/视野；ASO抗体850单位，可疑疾病是
A. 急性肾小球肾炎
B. 急性肾盂肾炎
C. 急性尿路感染
D. 亚急性细菌性心内膜炎
E. 风湿热

正确答案：A。急性肾小球肾炎